身体无病，每三月一行经者，称为
A. 激经
B. 暗经
C. 居经
D. 避年
E. 并月

正确答案：C。居经

解析：居经是一个生理学名词，又名季经、按季，是指妇女身体无病月经每三个月一行者（C对），亦属正常生理现象，不需治疗。并月即月经每两个月来潮1次（E错）。避年即月经1年1行（D错）。暗经即妇女终身不行经而仍能受孕（B错）。激经（A错）又叫“盛胎”或“垢胎”，指怀孕以后，月经仍按月来潮，且量、时间相对较短，而对孕妇、胎儿并无明显损害者，属生理现象。